因过量服用，可导致心律失常的药物是
A. 雄黄
B. 川乌
C. 蜂毒
D. 肉桂
E. 斑蝥

正确答案：B。川乌

解析：本题考查的是乌头类药物的中毒表现。因过量服用，可导致心律失常的药物是川乌（B对）。乌头类药物：（一）乌头类药物和含乌头类药物的中成药：1.中药材：川乌、草乌、附子、雪上一枝蒿等。2.中成药：追风丸、追风透骨丸、三七伤药片、附子理中丸、金匮肾气丸、木瓜丸、小金丸、风湿骨痛胶囊、祛风止痛片、祛风舒筋丸、正天丸、右归丸等。（一）中毒机制：主要有毒成分为乌头碱，一般中毒量为0.2mg，致死量为2～4mg。其毒性主要作用于神经系统，尤其是迷走神经等，使其先兴奋后抑制，并可直接作用于心脏，产生异常兴奋，可致心律失常，甚至引起室颤而死亡。（二）中毒表现 ：1.神经系统：表现为口舌、四肢及全身麻木，头痛，头晕，精神恍惚，语言不清或小便失禁，继而四肢抽搐、牙关紧闭、呼吸衰竭等。2.循环系统：表现为心悸气短、心律失常、血压下降、面色苍白、口唇发绀、四肢厥冷等。3.消化系统：表现为流涎、恶心、呕吐、腹痛、腹泻、肠鸣音亢进。雄黄（A错）及含雄黄的中成药：（一）含雄黄的中成药：牛黄解毒丸（片）、六神丸、喉症丸、安宫牛黄丸、牛黄清心丸、牛黄镇惊丸、牛黄抱龙丸、牛黄至宝丸、追风丸、牛黄醒消丸、紫金锭（散）、三品等。（一）中毒机制：雄黄主要成分含二硫化二砷，此外还含有少量三氧化二砷。砷盐毒性较大，进入体内后，蓄积和分布于体内各组织，主要分布在肝、肾、脾等内脏及指甲、毛发等部位。砷对机体的毒性作用是多方面的，首先危害神经细胞，使中枢神经中毒，产生一系列中毒症状，并直接影响毛细血管通透性。也可使血管舒缩中枢麻痹，而导致毛细血管扩张，并可引起肝、肾、脾、心脏等血管的脂肪变性和坏死。（二）中毒表现 ：1.消化系统表现为口腔咽喉干痛、烧灼感，口中有金属味，流涎，剧烈恶心呕吐、腹痛腹泻，严重时类似霍乱。2.各种出血症状，如吐血、咯血、眼结膜充血、鼻衄、便血、尿血等。3.肝肾功能损害而引起转氨酶升高、黄疸、血尿、蛋白尿等。4.严重者因心力衰竭、呼吸衰竭而死亡。5.长期接触可引起皮肤过敏，出现丘疹、疱疹、痤疮样皮疹等。蜂毒（B错）能导致溶血，也具肾毒性，应用时要严格限制剂量。肉桂（D错）过量会发生血尿，同时又是妊娠慎用中药。斑蝥（E错）的肾毒性极强，主要含有斑蝥酸酐，超量内服、外用或制药不慎均可引起中毒。因毒性强，发病迅速，故若治疗不及时可致肾功能不能完全恢复甚至死亡。